山楂可治疗
A. 肺心病
B. 静脉炎
C. 癫痫
D. 冠心病
E. 脑膜炎

正确答案：D。冠心病

解析：本题考查的是山楂的炮制作用。山楂可治疗冠心病（D对）。山楂：【炮制作用】山楂味酸、甘，性微温。归脾、胃、肝经。具有消食健胃、行气散瘀的功能。①山楂长于活血化瘀，常用于血瘀经闭，产后瘀阻，心腹刺痛，疝气疼痛以及高脂血症、高血压病、冠心病。②炒山楂酸味减弱，可缓和对胃的刺激性，善于消食化积。用于脾虚食滞，食欲不振，神倦乏力。③焦山楂不仅酸味减弱，且增加了苦味，长于消食止泻。用于食积兼脾虚和痢疾。④山楂炭其性收涩，具有止血、止泻的功效。可用于胃肠出血或脾虚腹泻兼食滞者。